对支撑呼吸道具有重要意义的喉软骨是
A. 甲状软骨
B. 环状软骨
C. 会厌软骨
D. 杓状软骨
E. 小角软骨

正确答案：B。环状软骨

解析：支撑呼吸道具有重要意义的喉软骨是环状软骨（B对）。